菊花按产地和加工方法不同分
A. 毫菊
B. 滁菊
C. 贡菊
D. 杭菊
E. 野菊

正确答案：A、B、C、D。毫菊；滁菊；贡菊；杭菊

解析：本题考查的是菊花的来源。菊花按产地和加工方法不同分亳菊（A对）、滁菊（B对）、贡菊（C对）与杭菊（D对）。菊花：【来源】为菊科植物菊的干燥头状花序。药材按产地和加工方法不同，分为“亳菊”“滁菊”“贡菊”“杭菊”“怀菊”。野菊（E错）的来源，2022年考试指南未明确说明。野菊：【来源】为菊科植物野菊等的干燥头状花序。